女，26岁，剖宫产术后1周，左下肢肿胀5天，查体，左小腿homans阳性，常见因素不包括
A. 高凝状态
B. 妊娠
C. 卧床
D. 剖宫产
E. 早日下地活动

正确答案：E。早日下地活动

解析：该患者女，26岁，剖宫产术后1周，左下肢肿胀5天，查体，左小腿homans阳性，结合患者的表现，提示为深静脉血栓形成，常见因素包括高凝状态(A对)、妊娠（B对）、卧床（C对）、剖宫产（D对），早日下地活动是预防深静脉血栓形成的措施（E错，为本题正确答案）。